双子叶植物根茎类中药的性状特征一般有
A. 表面无节和节间
B. 表面常有木栓层
C. 横切面有放射状结构
D. 断面中央有明显的髓部
E. 内皮层环明显

正确答案：B、C、D。表面常有木栓层；横切面有放射状结构；断面中央有明显的髓部

解析：本题考查的是双子叶植物根茎类中药的特征。双子叶植物根茎类中药的性状特征一般有表面常有木栓层（B对）、横切面有放射状结构（C对）与断面中央有明显的髓部（D对）。根茎表面有节和节间（A错），单子叶植物尤为明显。观察根茎的横断面，首先应注意区分双子叶植物根茎和单子叶植物根茎。一般来说，双子叶植物根茎外表常有木栓层；横切面有放射状结构，木部尤为明显；中央有明显的髓部；形成层环明显。单子叶植物根茎外表无木栓层或仅具较薄的栓化组织；横切面不呈放射状结构，皮层及中柱均有维管束小点散布；无髓部；通常可见内皮层环纹（E错）。其次，应注意根茎断面组织中有无分泌组织散布，如伞形科的川芎、白芷、羌活等，菊科的白术、苍术、木香等均有油点等。还应注意少数双子叶植物根茎的异常构造，如大黄的“星点”等。